关于食物转换时的注意事项说法正确的是
A. 食物不可以加油
B. 食物可以适当添加盐
C. 可以食用蜂蜜水
D. 可以多喝果汁
E. 可以用勺、杯进食

正确答案：E。可以用勺、杯进食

解析：本题考查食物转换的注意事项。食物转换的注意事项：1.食物清淡，无盐（B错）、少糖、少油（A错）；2.不食用蜂蜜水（C错）或糖水，尽量不喝果汁（D错）；3.用勺、杯进食（E对）可帮助口腔动作协调，学习吞咽；4.可在进食后再饮奶，自然形成一餐代替一顿奶，引入的食物不应影响总奶量。